患者，女，70岁。既往有冠心病，高血压病和慢性心功能不全病史，近日外感寒邪后出现心悸气短，不能平卧，咳吐泡沫痰，乏力，身寒肢冷，尿少，浮肿，面暗，舌红少苔，脉结代。治疗应首先考虑的方剂是
A. 养心汤合补肺汤
B. 桂枝甘草龙骨牡蛎汤合金匮肾气丸
C. 真武汤
D. 葶苈大枣泻肺汤
E. 生脉散

正确答案：C。真武汤

解析：水为阴邪，赖阳气化之，阳虚不能化水，湿邪内停，上凌于心，故见心悸，不能平卧，咳吐泡沫痰，乏力；阳气不能达于四肢，不能充养肌表，故见身寒肢冷；气化不利，水液内停故见尿少，浮肿，面暗；舌红少苔，脉结代均为阳虚水泛之侯，治当温阳化饮利水，方用真武汤（C对）。养心汤合补肺汤（A错）用于治疗心肺气虚证。桂枝甘草龙骨牡蛎汤合金匮肾气丸（B错）治疗心肾阳虚证。葶苈大枣泻肺汤（D错）用于治疗痰饮阻肺证。生脉散（E错）治疗气阴两虚证。